男，11个月。母乳喂养，近3月来面色渐苍白，间断腹泻，原可站立，现坐不稳，手足常颤抖。体检面色苍黄，略浮肿，表情呆滞。血红蛋白80g/L，红细胞2.0×10¹²/L，白细胞6.0×10⁹/L。确诊需作的检查是
A. 脑CT
B. 脑电图检查
C. 血清铁检查
D. 血清维生素B₁₂、叶酸测定
E. 血清钙、磷、碱性磷酸酶测定

正确答案：D。血清维生素B₁₂、叶酸测定

解析：根据患儿的哺乳方式为单纯母乳喂养，未添加辅食，临床表现为面色渐进苍白、苍黄，略浮肿，间断腹泻，出现神经精神症状坐不稳，手足颤抖，表情呆滞，以及实验室检查血红蛋白80g/L（儿童正常值：110-160g/L）、白细胞6.0×10⁹/L（儿童平均正常值8×10⁹/L）可判定为营养性巨幼红细胞性贫血，如精神症状明显，则考虑为维生素B12缺乏所致，可进一步测定血清维生素B12或叶酸水平协助确诊（D对）。